位于喉口至前庭裂平面之间
A. 喉前庭
B. 喉中间腔
C. 声门下腔
D. 声门裂
E. 前庭裂

正确答案：A。喉前庭

解析：喉前庭位于喉口至前庭裂平面之间（A对）。